继发龋的发生与下列哪项无关
A. 腐质未去净
B. 洞型制备不规范
C. 没有用窝洞消毒剂
D. 充填时操作不当
E. 材料调制不当

正确答案：C。没有用窝洞消毒剂

解析：本题考查继发龋发生的原因。只要彻底清洗窝洞，即使不使用消毒药物处理窝洞，充填后也很少产生继发龋（C错，为本题的正确答案）。继发龋产生的原因可能是腐质未去净（A对），原有龋变继续发展而成。洞型制备不规范，如洞缘未在自洁区，或在深的窝沟处，不便于清洁，菌斑易滞留，形成继发龋（B对）。充填时操作不当（D对）、材料调制不当（E对）易造成剩余牙体组织和充填体的边缘不密合，形成微渗漏，继发龋病。